某医生收集到数据经过统计学家分析应该进行t检验。应计算的指标是
A. 变异系数
B. 几何均数
C. 均数
D. 全距
E. 中位数

正确答案：C。均数

解析：平均数是统计中应用最广泛、最重要的一个指标体系。常用的有算术均数（均数）、几何均数、中位数三个指标。它们用于描述一组同质计量资料的集中趋势或反映一组观察值的平均水平。掌握“定量资料的统计描述和推断”知识点。